男性，52岁。反复无痛性肉眼血尿伴条状血块2月，膀胱镜见右输尿管口喷血，尿细胞学可见癌细胞。静脉尿路造影最有诊断价值的X线表现是
A. 右肾不显影
B. 右肾积水
C. 右肾萎缩
D. 右肾盂充盈缺损
E. 右肾盏破坏

正确答案：D。右肾盂充盈缺损

解析：中年男性患者，无痛性肉眼血尿伴条状血块，膀胱镜见右输尿管口喷血（提示可能有上尿路肿瘤），尿细胞学可见癌细胞，结合患者病史、临床表现和相关检查，应考虑为右侧肾盂癌。瘤体多为突向肾盂内的肿块，因此静脉尿路造影见肾盂充盈缺损（D对）对疾病的诊断具有重要价值。肾不显影（A错）提示患肾无功能，肾积水（B错）提示泌尿系梗阻，两者均不能明确病变的部位，故对疾病的诊断价值不大。静脉尿路造影只能显示尿路的改变，不能发现肾萎缩（C错）。肾盏破坏（E错）主要见于肾结核。